嘧啶环中的两个氮原子是来自于
A. 谷氨酰胺和氮
B. 谷氨酰胺和天冬酰胺
C. 谷氨酰胺和氨甲酰磷酸
D. 天冬酰胺和氨甲酰磷酸
E. 天冬氨酸和氨甲酰磷酸

正确答案：E。天冬氨酸和氨甲酰磷酸

解析：嘧啶核苷酸中嘧啶碱合成的原料包括谷氨酰胺、天冬氨酸、CO₂（合成嘧啶的两种氨基酸记忆为天（天冬氨酸）哪，俺家的谷子（谷氨酰胺）没干（没有甘氨酸）），而嘧啶环的合成始于谷氨酰胺合成氨基甲酰磷酸，因此嘧啶环中的两个氮原子来源于天冬氨酸和氨甲酰磷酸（E对）。合成嘌呤环的各元素来源包括天冬氨酸、谷氨酰胺、甘氨酸、CO₂及甲酰基等（合成嘌呤的三种氨基酸记忆为天（天冬氨酸）哪，俺家的谷子（谷氨酰胺）干了（甘氨酸）），嘌呤核苷酸中的四个氮原子来自于天冬氨酸、谷氨酰胺、甘氨酸。